不应列为心理应激对健康有消极影响的是
A. 使已有的疾病加重
B. 适应性调整，恢复内稳态
C. 使原有的疾病复发
D. 损害适应能力，引发心身症状
E. 与其他因素共同影响引发新的疾病

正确答案：B。适应性调整，恢复内稳态